来源于切牙管内的鼻腭导管上皮剩余可发生
A. 鼻唇（鼻牙槽）囊肿
B. 鼻腭管（切牙管）囊肿
C. 甲状舌管囊肿
D. 黏液囊肿
E. 鳃裂囊肿

正确答案：B。鼻腭管（切牙管）囊肿

解析：鼻腭管（切牙管）囊肿来源于切牙管内的鼻腭导管上皮剩余。掌握“鼻腭管囊肿及鼻唇囊肿”知识点。